氨在血液中主要运输形式是
A. 丙氨酸和谷氨酰胺
B. 谷氨酸和丙氨酸
C. 瓜氨酸和精氨酸
D. 半胱氨酸和瓜氨酸
E. 组氨酸和赖氨酸

正确答案：A。丙氨酸和谷氨酰胺

解析：此题考查的是氨的转运。氨在血液中的运输形式有两条途径，一条为丙氨酸-葡萄糖循环。肌肉中的氨基酸经转氨基作用将氨基转给丙酮酸生成丙氨酸，丙氨酸经血液运至肝脏。在肝脏中丙氨酸通过联合脱氨基作用释放出氨用于合成尿素。第二条途径为谷氨酰胺的生成及分解。谷氨酸与氨反应可以生成谷氨酰胺，有谷氨酰胺合成酶催化，此反应不可逆。谷氨酰胺的生成对维持组织氨的浓度起着重要的调节作用。生成的谷氨酰胺可及时经血液运向肾、小肠和肝脏，以便利用。可以认为谷氨酰胺是氨的解毒产物，也是氨的储存及运输的形式。掌握“氨基酸及氨的代谢”知识点。